下列各项，不属胎动不安和异位妊娠鉴别要点的是
A. 阴道出血
B. 腹痛程度、性质
C. B超检测孕囊着床部位
D. 妇检宫颈举痛
E. 妇检附件包块

正确答案：A。阴道出血

解析：胎动不安和异位妊娠都可见阴道出血。胎动不安的阴道出血以：少量，淡红、暗红或鲜红或淡黯为主；而异位妊娠的阴道出血以：点滴状或少量褐色为主，但二者出血的颜色临床多难以区别（A对）。胎动不安的下腹痛：无或者轻；异位妊娠下腹痛：少腹隐痛、突发剧痛（B错）。B超检测胎动不安：宫内有胎心胎动；异位妊娠：宫内无胚胎，宫外（多在附件）有包块或孕囊（C错）。胎动不安宫颈未扩张；异位妊娠宫颈口闭、摇举痛（D错）。胎动不安附件检查阴性；异位妊娠附件检查可有小包块，触痛明显（E错）。